符合母乳特点的是
A. 蛋白质总量高
B. 白蛋白少
C. 含饱和脂肪酸的脂肪高
D. 乳糖量少
E. 钙磷比例适当

正确答案：E。钙磷比例适当

解析：母乳喂养的优点钙磷比例适宜（2:1），易于吸收，故较少发生佝偻病。掌握“婴儿喂养方法”知识点。